2002年卫生部颁布的《职业性中暑诊断标准及处理原则》中规定职业性中暑诊断及分级标准为
A. 轻症中暑，重度中暑和重症中暑
B. 中暑先兆，轻症中暑和重症中暑
C. 热射病，热痉挛和热衰竭
D. 轻症中暑，重症中暑
E. 以上都不是

正确答案：D。轻症中暑，重症中暑

解析：本题考查2002年卫生部颁布的《职业性中暑诊断标准及处理原则》。2002年卫生部颁布的《职业性中暑诊断标准及处理原则》中规定职业性中暑诊断及分级标准为：轻症中暑和重症中暑（D对ABCE错）。1.轻症中暑：具备下列情况之一者，诊断为轻症中暑。①头昏、胸闷、心悸、面色潮红、皮肤灼热；②有呼吸与循环衰竭的早期症状，大量出汗、面色苍白、血压下降、脉搏细弱而快；③肛温升高达38.5℃以上。2.重症中暑：凡出现前述热射病、热痉挛或热衰竭的主要临床表现之一者，可诊断为重症中暑。